知母除清热泻火外，又能
A. 凉血解毒
B. 散结消肿
C. 滋阴润燥
D. 消肿排脓
E. 除烦止呕

正确答案：C。滋阴润燥

解析：本题考查的是知母的功效。知母除清热泻火外，又能滋阴润燥（C对）。知母：【功效】清热泻火，滋阴润燥。栀子：【功效】泻火除烦，清热利尿，凉血解毒（A错），消肿止痛。夏枯草：【功效】清肝明目，散结消肿（B错）。天花粉：【功效】清热生津，清肺润燥，消肿排脓（D错）。芦根：【功效】清热生津，除烦止呕（E错），利尿。